适应性免疫应答的特点不具有
A. 特异性
B. 非特异性
C. 多样性
D. 记忆性
E. 耐受性

正确答案：B。非特异性